下列有关乙脑极期表现的叙述，错误的是
A. 高热惊厥
B. 病理征阳性
C. 脑膜刺激征阳性
D. 瘫痪多不对称，肢体松弛
E. 颅高压表现及呼吸衰竭

正确答案：D。瘫痪多不对称，肢体松弛

解析：2.极期 病程第4～10日、在初期症状基础上，出现脑实质受损表现：（1）高热 体温持续上升，达40℃以上，一般持续7～10日，重者可达3周或以上；体温高低和热程长短与病情轻重相关。（2）意识障碍 表现为程度不等的嗜睡、谵妄、定向力障碍或昏迷等；最早可见于病程第1～2日。多见于第3～8日、通常持续1周左右、重者可长达4周以上；昏迷程度的深浅、发生的早晚及持续时间的长短与病情的严重性和预后密切相关。（3）惊厥或抽搐 是病情严重的表现，系高热、脑实质炎症及脑水肿所致，发生率为40%～60%多于病程第2～5日出现，先有面部、眼肌、口唇的小抽搐，随后呈肢体阵挛性抽搐、重者出现全身抽搐，强直性痉挛，历时数分钟至数十分钟不等，并反复发作，均伴有意识障碍。频繁或长时间抽搐可导致紫绀、脑组织缺氧和脑水肿、昏迷程度加深，甚至呼吸暂停（A对）。（4）呼吸衰竭 多见于重症患者，由脑实质炎症、缺氧、脑水肿、颅内高压、脑疝和低钠性脑病等所致。其中以脑实质病变，尤其是延髓呼吸中枢病变为主。主要表现为呼吸节律不规则及幅度不均，如呼吸表浅、双吸气、叹息样呼吸、潮式呼吸、抽泣样呼吸等，最后呼吸停止。有时可出现外周性呼吸衰竭，多由脊髓病变致呼吸肌麻痹所致，表现为呼吸先快后慢，胸式或腹式呼吸减弱，发绀，但呼吸节律规整（E错，为本题正确答案）。（5）脑膜刺激征 表现为颈项强直、克氏征或布氏征阳性，发生率为40%～60%婴幼儿常表现为前囟隆起而脑膜刺激征缺如（C对）。（6）其他 神经系统症状和体征多在病程10日内出现，2周后较少出现新的神经症状和体征。常有浅反射先减弱后消失，膝、跟腱反射等深反射先亢进后消失，锥体束征阳性。昏迷时，除浅反射消失外，可有肢体强直性瘫痪、偏瘫或全瘫（D错），伴肌张力增高，还可伴膀胱或直肠麻痹（大、小便失禁或尿潴留）。此外，根据病变部位不同，可有颅神经损伤或自主神经功能紊乱的表现（B对）。（7）循环衰弱 少见，常与呼吸衰竭同时出现，表现为血压下降、脉搏细速，可伴胃肠道出血。